治疗痿证肝肾亏损证，应首选
A. 虎潜丸
B. 圣愈汤
C. 鹿角胶丸
D. 补血荣筋丸
E. 独活寄生汤

正确答案：A。虎潜丸

解析：痿证肝肾亏损证治宜补益肝肾，滋阴清热，方选滋阴降火，强壮筋骨的虎潜丸（A对）。圣愈汤合补阳还五汤功能益气养营，活血行瘀，为治疗痿证脉络瘀阻证的选方（B错）。痿证肝肾亏损证若病久阴损及阳，阴阳两虚，兼有怕冷，阳痿，小便清长，脉沉细无力者，不可用寒凉药以伐生气，方选鹿角胶丸（C错）。补血荣筋丸功能滋阴补血，强筋健骨，可用于治疗痿证偏血虚者，不常用（D错）。独活寄生汤功能益肝肾，补气血，祛风湿，止痹痛，为治疗痹证肝肾亏虚证的主方（E错）。